体内脂肪大量动员时，肝内乙酰辅酶A主要生成的物质是
A. 葡萄糖
B. 酮体
C. 胆固醇
D. 脂肪酸
E. 二氧化碳和水

正确答案：B。酮体

解析：本题考查甘油三酯代谢。体内脂肪大量动员时，肝内乙酰辅酶A主要生成的物质是酮体（B对），酮体的生成以脂肪酸β-氧化产生的大量乙酰CoA为原料，在肝线粒体由酮体合成酶系催化完成。葡萄糖（A错）生成可见于肝内的葡糖-6-磷酸酶水解糖原分解产生的葡糖-6-磷酸。胆固醇（C错）生成的主要场所为肝，合成的基本原料为乙酰CoA和NADPH。脂肪酸（D错）的生成主要来源为小肠消化吸收的外源性脂肪酸和肝合成的内源性脂肪酸，主要合成场所为肝脏。二氧化碳和水（E错）生成主要见于葡萄糖彻底氧化。